有研究者欲分析白酒的平均销售量与肝癌的死亡率之间的关系，收集了1998年全国20个大城市白酒的平均销售量与肝癌的死亡率资料。在应用该方法时易发生的错误是
A. 暴露污染
B. 匹配过度
C. 生态学谬误
D. 霍桑效应
E. 失访

正确答案：C。生态学谬误